下列各项，不属于气逆证表现的是
A. 头痛头晕
B. 嗳气呃逆
C. 腹部胀满
D. 恶心呕吐
E. 咳嗽喘息

正确答案：C。腹部胀满

解析：腹部胀满为气滞证的表现（C错，为本题正确答案）。气逆多由情志所伤，或因饮食不当，或因外邪侵犯，或因痰浊壅阻所致，亦有因虚而气机上逆者。气逆最常见于肺、胃和肝等脏腑。在肺，则肺失肃降，肺气上逆，发为咳逆上气（E对）。在胃，则胃失和降，胃气上逆，发为恶心、呕吐（D对）、嗳气、呃逆（B对）。在肝，则肝气上逆，发为头痛头胀（A对），面红目赤，易怒等症。由于肝为刚脏，主动主升，又为藏血之脏，因此在肝气上逆时，甚则可导致血随气逆，或为咯血、吐血，乃至壅遏清窍而致昏厥。